小儿有牙18个，会用汤匙吃饭，能说2～3字拼成的短语，其年龄为
A. 1岁
B. 1岁半
C. 2岁
D. 2岁半
E. 3岁

正确答案：C。2岁

解析：两岁以内乳牙数=月龄-（4～6岁），本例有牙18个，月龄为22～24个月；2岁儿会用汤匙吃饭，能说2-3字拼成的短语，故本例小儿年龄为2岁（C对）。2岁半小儿已经能说短歌谣，而不仅仅是只能说2-3字拼成的短语（D错）。